有关肛裂的描述，正确的是
A. 老年人发病率高
B. 常伴发大出血
C. 最常见于膝胸位肛门12点处
D. 应以手术治疗为主
E. 多因慢性腹泻发生

正确答案：C。最常见于膝胸位肛门12点处

解析：多数肛裂位于膝胸位肛门12点处（C对）。肛裂多见于青中年人（A错）；可有少量出血，大出血少见（B错）；多数只需非手术方式治疗，对于保守治疗无效、症状较重者应以手术治疗为主（D错）；肛裂多因便秘、粪便干结发生（E错）。